男，68岁。半年来每天排便4～5次，便中带血及黏液。突发腹胀、停止排气排便2天。查体：T37.2℃。全腹轻微压痛，左侧腹部平脐可触及包块，腹部叩诊鼓音，肠鸣音6～7次/分，直肠指诊未触及肿物。实验室检查：H90g/L，WBC6.7×10⁹/L。X线透视全腹多个气液平。为明确诊断最合适的检查是
A. 结肠镜
B. 腹部B超
C. 腹部CT
D. 全消化道钡剂造影
E. 胃镜

正确答案：A。结肠镜

解析：老年患者，便频、血便，停止排气排便、X线示气液平（肠梗阻症状），左侧腹部包块，考虑左侧结肠癌。结肠镜检查可直接观察病变范围和程度，并可取组织活检，为明确诊断最合适的检查是结肠镜（A对）。肠道气体较多，影响超声成像，腹部B超（B错）不适用于患者。腹部CT（C错）常用于了解腹腔脏器和淋巴结转移情况及对疾病分期的判断。全消化道钡剂造影（D错）对结肠癌仅有提示意义，不能确诊。胃镜（E错）常用于诊断胃部疾病。